黏膜固有层血管增生，扩张及充血形成的病变
A. 疱
B. 溃疡
C. 斑
D. 糜烂
E. 角化不良

正确答案：C。斑

解析：本题考查口腔黏膜疾病的临床基本病损。黏膜固有层血管增生，扩张及充血形成的病变为斑（C对）。斑是指皮肤黏膜上的颜色改变，红斑为黏膜固有层血管扩张、增生和充血。疱（A错）：黏膜内贮存液体而成疱性病损，疱损直径小于1cm。溃疡（B错）：是黏膜上皮的完整性发生连续性缺损或破坏，因其表层坏死脱落而形成凹陷。糜烂（D错）：是黏膜的一种表浅缺损，为上皮的部分损伤，不损及基底细胞层。角化不良（E错）：指表皮或附属器个别角质形成细胞未至角质层，即显示过早角化。